男，32岁。会阴部骑跨伤5小时。伤后会阴部疼痛，尿道口滴血，不能自行排尿。生命征稳定，阴囊肿大、青紫。正确的处理方法是
A. 抗感染
B. 经会阴尿道断端吻合+引流尿外渗
C. 膀胱造瘘
D. 导尿
E. 应用止血药

正确答案：B。经会阴尿道断端吻合+引流尿外渗

解析：青年男性患者，会阴部骑跨伤后会阴部疼痛，尿道口滴血，不能自行排尿（提示可能有尿道断裂），阴囊肿大、青紫（前尿道损伤的典型表现），结合患者病史和临床表现，该患者最可能的诊断为前尿道断裂。患者生命征稳定，一般状况良好，故此时应行尿道端端吻合术修复断裂的尿道。患者有阴囊肿大、青紫，说明有尿液外渗，应尽早在外渗部位做皮肤切开，置管引流。故该患者此时最适宜的处理方法是经会阴尿道断端吻合+引流尿外渗（B对）。抗感染（A错）、应用止血药（E错）仅为一般辅助治疗措施。膀胱造瘘（C错）主要用于尿道损伤尿潴留的急症处理。导尿（D错）不适用于有尿道断裂的患者，一般于尿道吻合手术后进行。